积聚中期的治疗原则
A. 攻邪、行气活血
B. 扶正培本
C. 攻补兼施
D. 调气
E. 疏肝理气

正确答案：C。攻补兼施

解析：积证治疗宜分初、中、末三个阶段：积证初起，正气未虚，邪气尚浅，治疗应以攻邪为主；积证中期积块较硬，正气逐渐受损，邪实正虚，治疗应在攻邪的同时治宜扶助正气，故攻补兼施（C对）；积证后期，机体久受邪气侵袭，正气虚极不足以支持机体消除邪气，所以应该补正除积，以补为主。